属于5-羟色胺和去甲肾上腺素再摄取抑制剂的是
A. 阿米替林
B. 氟西汀
C. 吗氯贝胺
D. 文拉法辛
E. 米氮平

正确答案：D。文拉法辛

解析：本题考查文拉法辛。文拉法辛（D对）为5-HT及去甲肾上腺素再摄取抑制剂代表药，该类药主要通过抑制5-HT及去甲肾上腺素再摄取，增强中枢5-HT能及NE能神经功能而发挥抗抑郁作用。阿米替林（A错）为三环类抗抑郁药的代表药，该类药主要通过抑制突触前膜对5-HT及去甲肾上腺素的再摄取，使突触间隙的去甲肾上腺素和5-HT浓度升高，促进突触传递功能而发挥抗抑郁作用。氟西汀（B错）及其代谢产物去甲氟西汀都选择性地抑制中枢神经系统对5-HT的再吸收，延长和增加5-HT的作用，为较强的抗抑郁药。吗氯贝胺（C错）为单胺氧化酶抑制剂代表药，该类药通过抑制A型单胺氧化酶，减少去甲肾上腺素、5-HT及多巴胺的降解，增强去甲肾上腺素、5-HT及多巴胺能神经功能而发挥抗抑郁作用。米氮平（E错）为去甲肾上腺素能及特异性5-HT能抗抑郁药，主要通过阻断中枢NE能和5-HT能神经末梢突触前α₂受体，增加NE和5-HT的间接释放，增强中枢NE能及5-HT能神经的功能，从而达到抗抑郁作用。